易发生水解降解反应的药物是
A. 吗啡
B. 肾上腺素
C. 布洛芬
D. 盐酸氯丙嗪
E. 头孢唑林

正确答案：E。头孢唑林

解析：本题考查药物降解途径。头孢唑林（E对）易发生水解降解反应。水解是药物降解的主要途径，属于这类降解的药物主要有酯类、酰胺类等。（1）酯类药物的水解：含有酯键的药物在水溶液中或吸收水分后，易发生水解反应，在H⁺或OH⁻或广义酸碱的催化下，反应还可加速。（2）酰胺药物的水解：酰胺药物水解后生成酸与胺。属于这类的药物有青霉素类、头孢菌素类、氯霉素、巴比妥类等。头孢唑林属于头孢菌素类药物，由于分子中含有β-内酰胺环，易于水解。吗啡（A错）、肾上腺素（B错）属于酚类药物，分子中有酚羟基，易氧化降解。氯丙嗪（D错）分子中的酮-氯键遇光被分解产生自由基，易氧化。布洛芬（C错）可溶于氢氧化钠或碳酸钠的水溶液中。